对大豆营养特点不正确的描述
A. 大豆蛋白是最好的植物性蛋白
B. 大豆蛋白富含蛋氨酸
C. 大豆脂肪含丰富的亚油酸
D. 大豆含较多的钙、硫胺素和核黄素
E. 大豆蛋白质富含赖氨酸

正确答案：B。大豆蛋白富含蛋氨酸